五体中与脾相合的是
A. 脉
B. 皮
C. 肉
D. 筋
E. 骨

正确答案：C。肉

解析：本题考查五脏与五体的关系。脾在体合肉，是指脾气的运化功能与肌肉的壮实及其功能发挥之间有着密切的联系（C对）。心在体合脉（A错），肺在体合皮（B错），肝在体合筋（D错），肾在体合骨（E错）。